采用含氯消毒剂进行消毒的医疗机构污水，若直接排入地表水体和海域，其总氯量必须小于
A. 0.3mg/L
B. 0.5mg/L
C. 0.8mg/L
D. 1.0mg/L
E. 2.0mg/L

正确答案：B。0.5mg/L

解析：本题考查医疗机构污水处理的相关内容。医院污水消毒最常用的方法是氯化消毒，主要以次氯酸钠作为消毒剂。当消毒剂投加量及与污水接触时间充足时，通常可实现杀灭病原体的目标。采用含氯消毒剂消毒医疗机构污水时，若直接排入地表水体和海域，应先进行脱氯处理，使总余氯小于0.5mg/L（B对ACDE错）。